几种不同的细胞因子作用于同一种靶细胞为
A. 细胞因子的多效性
B. 细胞因子的重叠性
C. 细胞因子的拮抗性
D. 细胞因子的协同性
E. 细胞因子的特异性

正确答案：B。细胞因子的重叠性

解析：两种或两种以上的细胞因子具有同样或类似的生物学作用，例如IL-2、IL-7、IL-15均可刺激T细胞增殖。掌握“细胞因子及受体”知识点。